患者因关节疼痛就诊，诊断为骨性关节炎，有磺胺类药物过敏史，该患者禁用的止痛药是
A. 萘普生
B. 布洛芬
C. 对乙酰氨基酚
D. 塞来昔布
E. 美洛昔康

正确答案：D。塞来昔布

解析：本题考查塞来昔布的不良反应。该患者禁用的止痛药是塞来昔布（D对）。塞来昔布为选择性COX-2抑制剂，含有磺胺类结构，故磺胺类药物过敏者禁用。塞来昔布能够增加心肌梗死风险；消化道溃疡风险较低；不抑制血小板活性；如联合服用华法林会增加INR；中至重度肝功能不全患者避免使用；可引起肾损害。萘普生（A错）、布洛芬（B错）、对乙酰氨基酚（C错）、美洛昔康（E错）结构中均不含磺胺基团，故可以使用。